患者男性，67岁，吸烟，有COPD病史30余年。家属发现患者呼之不应半小时急送医院。查体：BP150/75mmHg，浅昏迷状，球结膜水肿，双肺可闻及干、湿啰音，A₂＜P₂，下肢水肿。为明确诊断首选的检查是
A. 动脉血气分析
B. 胸部X线片
C. 心脏超声波
D. 动态心电图
E. 肺功能

正确答案：A。动脉血气分析